某医院心血管内科2010年和2011年死于急性心肌梗死的病例数分别为81人和101人，那么和2010年相比
A. 2011年收治的心肌梗死患者死亡危险性更大
B. 2011年收治的心肌梗死患者抢救失败的情况更为严重
C. 2011年的心肌梗死死亡危险的增加不会有统计学意义
D. 不能判断该科收治的心肌梗死患者的死亡频率2011年升高
E. 2011年某地区心肌梗死的发病率增加

正确答案：D。不能判断该科收治的心肌梗死患者的死亡频率2011年升高

解析：本题考查病死率的相关内容。病死率表示一定时期内因某病死亡者占该病病人的比例，表示某病病人因该病死亡的危险性。题干中未提及2010年和2011年这两年中心肌梗死的患病人数，因此不能计算病死率，也就无法判断该科收治的心肌梗死患者的死亡频率（D对ABCE错）。